女性，26岁。因甲状腺功能亢进行甲状腺切除，术后第二天出现手足抽搐。最可能的原因是
A. 喉上或喉返神经损伤
B. 甲状腺功能低下
C. 甲状腺危象
D. 喉头水肿
E. 甲状旁腺功能低下

正确答案：E。甲状旁腺功能低下

解析：患者因甲状腺功能亢进行甲状腺切除，术后第二天出现手足抽搐，最可能的原因是甲状旁腺功能低下（ E对）。喉上或喉返神经损伤（A错）可造成声音嘶哑，误咽发生呛咳。甲状腺危象（C错）主要表现为高热、脉快，无抽搐现象。甲状腺功能低下（B错）主要表现为表情淡漠、智力减退。喉头水肿（D错）主要表现为喉痛和呼吸困难。